以下哪一个不是流行病学的特征
A. 群体特征
B. 以分布为起点的特征
C. 以治疗疾病为主的特征
D. 对比的特征
E. 预防为主的特征

正确答案：C。以治疗疾病为主的特征

解析：本题考查流行病学的基本特征。流行病学的基本特征包括：（1）群体的特征（A对），流行病学是研究人群中的疾病现象与健康状态，即从人群的各种分布（B对）现象入手，将分布作为研究一切问题的起点；（2）对比的特征（D对），对比是流行病学研究方法的核心；（3）概率论和数理统计学的特征；（4）社会心理的特征；（5）预防为主的特征（E对）；（6）发展的特征。流行病学是以预防为主的学科，面向人群，而非以治疗疾病为主（C错，为本题正确答案）。